男，18岁，因急性阑尾炎穿孔行阑尾切除术，术后3天切口红肿，有脓性分泌物，将缝线拆除后引出20ml脓液，10天后再次缝合而愈合，该病人切口愈合类型应记为
A. Ⅱ/乙
B. Ⅱ/丙
C. Ⅲ/甲
D. Ⅲ/乙
E. Ⅲ/丙

正确答案：E。Ⅲ/丙

解析：阑尾穿孔的阑尾切除术手术时，切口邻近污染区、组织直接暴露于污染物，故属于Ⅲ类切口。术后切口红肿、化脓，有脓液引出，故属于丙级愈合。因此该病人切口愈合类型为Ⅲ/丙（E对）。切口的分类：①清洁切口（Ⅰ类切口），指缝合的无菌切口，如甲状腺大部切除术等。②可能污染切口（Ⅱ类切口），指手术时可能带有污染的缝合切口，如胃大部切除术等（AB错）。③污染切口（Ⅲ类切口），指邻近感染区或组织直接暴露于污染或感染物的切口，如阑尾穿孔的阑尾切除术，肠梗阻坏死肠管切除手术等。切口的愈合也分为三级：①甲级愈合，用“甲”字代表，指愈合优良，无不良反应（C错）。②乙级愈合，用“乙”字代表，指愈合处有炎症反应，如红肿、硬结、血肿、积液等，但未化脓（D错）。③丙级愈合，用“丙”字代表，指切口化脓，需要作切开引流等处理。